肺炎链球菌荚膜多糖免疫家兔出现的情况是
A. 诱导细胞免疫和体液免疫
B. 产生大量的IgG
C. 产生大量的IgM
D. 可发生再次应答
E. 发生迟发型超敏反应炎症

正确答案：C。产生大量的IgM